影响滴眼剂药物吸收的错误表述是
A. 滴眼剂溶液的表面张力大小可影响药物被吸收
B. 增加药液的粘度使药物分子的扩散速度减低，因此不利于药物被吸收
C. 由于角膜的组织构造能溶于水又能溶于油的药物易透入角膜
D. 生物碱类药物本身的pH值可影响药物吸收
E. 药液刺激性大，可使泪液分泌增加而使药液流失，不利于药物吸收

正确答案：B。增加药液的粘度使药物分子的扩散速度减低，因此不利于药物被吸收